下列关于沙眼流行病学，错误的描述是
A. 沙眼是由沙眼衣原体引起的一种急性传染性眼病
B. 幼儿期和学龄期儿童沙眼患病率高
C. 如不及时治疗，沙眼发展到晚期常因并发症而导致视力障碍乃至失明
D. 沙眼主要通过接触被沙眼衣原体污染的手、毛巾、水等进行传播
E. 感染沙眼的主要原因是由不良的卫生习惯引起病原体传播

正确答案：A。沙眼是由沙眼衣原体引起的一种急性传染性眼病